某医师治十二指肠溃疡疼痛、出血，胃酸过多用止血定痛片。该中成药的功能是
A. 清肠，止血，止痛
B. 消肿，止血，止痛
C. 止痛，止血，凉血
D. 散瘀，止血，止痛
E. 止血，除湿，止痛

正确答案：D。散瘀，止血，止痛

解析：本题考查的是止血定痛片的功能。中成药止血定痛片的功能是散瘀，止血，止痛（D对）。止血定痛片：【功能】散瘀，止血，止痛。三七片：【功能】散瘀止血，消肿止痛（B错）。宫血宁胶囊：【功能】凉血止血，清热除湿，化瘀止痛（CE错）。功能为清肠，止血，止痛（A错）的中成药，2022年考试指南未明确说明。